流痰最容易发生的部位是
A. 四肢长骨
B. 髂骨
C. 膝关节
D. 脊椎
E. 淋巴结

正确答案：D。脊椎

解析：流痰是一种骨与关节间的慢性化脓性疾病，因其成脓后脓液流窜于病变附近或较远的组织间隙，壅阻而形成脓肿，破损后脓液稀薄如痰而得名，后期容易出现虚劳症状，病变部位以脊椎为最多，其次为下肢髋、膝、踝关节，再次为上肢肩、肘、腕、指关节等骨关节（D对）。四肢长骨和膝关节是流痰病变部位仅次于脊椎的部位（AC错）。髂骨和淋巴结不是流痰病变的部位（BE错）。